对酸、碱均稳定的极性吸附剂是
A. 聚酰胺
B. 离子交换树脂
C. 硅胶
D. 大孔吸附树脂
E. 膜

正确答案：D。大孔吸附树脂

解析：本题考查的是大孔吸附树脂的性质。对酸、碱均稳定的极性吸附剂是大孔吸附树脂（D对）。大孔吸附树脂为大孔树脂吸附法的吸附剂，通常分为非极性和极性两大类。大孔吸附树脂的吸附原理：大孔吸附树脂具有选择性吸附和分子筛的性能。它的吸附性是由于范德华引力或产生氢键的结果，分子筛的性能是由其本身的多孔性网状结构决定的。大孔树脂吸附法的洗脱液可选择水、甲醇、乙醇、丙酮、不同浓度的酸碱等。聚酰胺（A错）为聚酰胺吸附色谱法的吸附剂。聚酰胺的性质及吸附原理：商品聚酰胺均为高聚物，不溶于水、甲醇、乙醇、乙醚、三氯甲烷及丙酮等常用有机溶剂，对碱较稳定，对酸尤其是无机酸稳定性较差。离子交换树脂（B错）为离子色谱法的固定相。中药化学成分中，具有酸性、碱性及两性基团的分子，在水中多呈解离状态，据此可用离子交换法或电泳技术进行分离。离子交换树脂的结构及性质：离子交换树脂外观均为球形颗粒，不溶于水，但可在水中膨胀。硅胶（C错）为硅胶吸附色谱法的吸附剂。硅胶吸附色谱法：是根据物质的吸附性差别进行分离的方法。属于物理吸附。膜（E错）应用于膜分离法中。膜分离法是一种用天然或人工合成的膜，以外界能量或化学位差为推动力，对双组分或多组分的溶质和溶剂进行分离、分级、提纯或富集的方法。目前，膜过滤技术主要包括渗透、反渗透、超滤、电渗析和液膜技术等。